具有负性肌力与负性频率的抗心衰药是
A. 地高辛
B. 依那普利
C. 氢氯噻嗪
D. 卡维地洛
E. 硝普钠

正确答案：D。卡维地洛

解析：本题考查抗慢性心功能不全药。卡维地洛（D对）为α₁、β肾上腺素受体阻断药，通过阻断心脏β受体，降低心脏肌力以及减慢心率，是第一个用于治疗心衰的β受体阻断药。地高辛（A错）是一种中效强心苷类药物，对心脏的作用表现为正性肌力作用，减慢心率，抑制心脏传导。依那普利（B错）为血管紧张素Ⅱ受体阻断药。氢氯噻嗪（C错）为噻嗪类利尿药。硝普钠（E错）为血管扩张药。